关于妊娠期龈炎，哪项正确
A. 妊娠本身即可引起龈炎
B. 无局部刺激物及菌斑，妊娠龈炎也会发生
C. 可发生于个别牙或全口牙龈，后牙区重于前牙区
D. 妊娠期性激素水平的改变，可使原有的慢性龈炎加重或改变特征
E. 妊娠瘤体积较大，妨碍进食者，可尽量选择妊娠7～9个月之间手术切除

正确答案：D。妊娠期性激素水平的改变，可使原有的慢性龈炎加重或改变特征

解析：本题考查妊娠期龈炎。妊娠期龈炎指妇女在妊娠期间，由于妊娠期性激素水平的改变，可使原有的慢性龈炎加重或改变特征（D对），使牙龈肿胀或形成龈瘤样的改变。妊娠本身不会引起龈炎（A错），无局部刺激物及菌斑，妊娠并不会引起牙龈的炎症（B错）。妊娠期龈炎可发生于个别牙龈或全口的牙龈，前牙区为重于后牙区（C错）。妊娠瘤体积较大，妨碍进食者，则可在彻底清除局部刺激因素后考虑手术切除。手术时机应尽量选择在妊娠期的4～6月内（E错）。